流行病学中病因推断的性质是
A. 分析流行病学的指导框架和评价准则
B. 流行病学的一般思维方式和逻辑方法
C. 医学研究中因果关系的逻辑标准
D. 预防医学或公共卫生的逻辑思维框架
E. 人群研究的一般思维方式和逻辑方法

正确答案：A。分析流行病学的指导框架和评价准则

解析：本题考查病因推断的性质。流行病学中病因推断的性质是分析流行病学的指导框架和评价准则（A对BCDE错）。